男，30岁，四肢、躯干重度烧伤，6天后高热、谵妄，周身皮疹，创面有较多黄稠脓性分泌物。该病人经积极治疗，联合应用大量广谱抗生素，病情好转，但仍有低热。一直持续应用抗生素，15天后病人又突发寒战，高热达40℃，神志淡漠，嗜睡，休克，白细胞计数25×109/L。此时应考虑并发
A. 中毒性休克
B. 革兰阳性细菌败血症
C. 革兰阴性细菌败血症
D. 绿脓杆菌败血症
E. 全身化脓性感染

正确答案：E。全身化脓性感染

解析：全身化脓性感染典型的表现有：骤起寒战，继以高热可达40～41℃；继而出现感染性休克；实验室检查白细胞计数明显增高，一般常可达（20～30）×109/L以上等。掌握“外科感染”知识点。